颞下颌关节紊乱病的诊断，不能采取下列哪一项
A. 病史询问
B. 临床检查
C. 许勒位及经咽侧位X线光片
D. 颞下颌关节区手术探查
E. 关节造影片

正确答案：D。颞下颌关节区手术探查

解析：本题考查颞下颌关节紊乱病的诊断。颞下颌关节区手术探查（D错，为本题的正确答案）可对颞下颌关节区的疾病作出明确诊断，但因手术创伤大、愈合慢，故优先以保守治疗为主，手术探查法仅适用于已确诊患有颞下颌关节疾病且有明显手术适应者。引起该疾病的因素有很多如心理社会因素、牙合因素、免疫因素、关节解剖因素等，患者一般都有下颌运动异常、疼痛、弹响和杂音的临床症状，可通过病史询问（A对）结合临床检查（B对）对患者的疾病作出初步推断。许勒位及经咽侧位X线光片（C对）可发现患者是否有关节间隙改变和骨质改变，是临床上常用的辅助检查手段。关节造影片（E对）和磁共振检查可发现患者是否有关节盘移位、穿孔及关节盘诸附着的改变等。